明目地黄丸的主治是
A. 风热上攻所致的目赤肿痛
B. 肝郁血虚所致的目珠夜痛
C. 气阴两虚所致的视物昏花
D. 肝肾阴虚所致的视物模糊
E. 肝血不足所致的青盲雀目

正确答案：D。肝肾阴虚所致的视物模糊

解析：本题考查的是明目地黄丸的主治。明目地黄丸的主治是肝肾阴虚所致的视物模糊（D对）。明目地黄丸：【主治】肝肾阴虚所致的目涩畏光、视物模糊、迎风流泪。黄连上清丸：【主治】风热上攻、肺胃热盛所致的头晕目眩、暴发火眼（A错）、牙齿疼痛、口舌生疮、咽喉肿痛、耳痛耳鸣、大便秘结、小便短赤。复方血栓通胶囊：【主治】血瘀兼气阴两虚证的视网膜静脉阻塞，症见视力下降或视觉异常、眼底瘀血征象、神疲乏力、咽干、口干等；以及血瘀兼气阴两虚的稳定型劳累性心绞痛，症见胸闷痛、心悸、心慌、气短、乏力、心烦、口干等（C错）。主治为肝郁血虚所致的目珠夜痛（B错）或肝血不足所致的青盲雀目（E错）的中成药，2022年考试指南未明确说明。